关于气雾剂、喷雾剂质量检査项目的说法，正确的有
A. 定量气雾剂应检查每揿主药含量
B. 非定量气雾剂应检查每瓶总喷次
C. 定量喷雾剂应检查每喷主药含量
D. 非定量气雾剂应检查每瓶的喷射速率
E. 定量气雾剂应检查递送剂量均一性

正确答案：A、B、C、D、E。定量气雾剂应检查每揿主药含量；非定量气雾剂应检查每瓶总喷次；定量喷雾剂应检查每喷主药含量；非定量气雾剂应检查每瓶的喷射速率；定量气雾剂应检查递送剂量均一性

解析：本题考查的是气雾剂、喷雾剂的质量检查项目与要求。关于气雾剂、喷雾剂质量检査项目的说法，正确的有定量气雾剂应检查每揿主药含量（A对）、非定量气雾剂应检查每瓶总喷次（B对）、定量喷雾剂应检查每喷主药含量（C对）、非定量气雾剂应检查每瓶的喷射速率（D对）与定量气雾剂应检查递送剂量均一性（E对）。气雾剂、喷雾剂的质量检查项目与要求有以下几点。1.每瓶总揿次：定量气雾剂每瓶总揿数应不少于标示总揿数。2.每瓶总喷次：多剂量定量喷雾剂每瓶总喷次均不得少于其标示总喷次。3.递送剂量均一性：定量气雾剂照吸入制剂相关项下方法检查，递送剂量均一性应符合规定；定量吸入喷雾剂、混悬型和乳液型定量鼻用喷雾剂照吸入制剂或鼻用制剂相关项下方法检查应符合规定。4.递送速率和递送总量：供雾化器用的吸入喷雾剂应检查活性物质递送速率和递送总量，照吸入制剂相关项下方法检查，应符合规定。5.每揿主药含量：定量气雾剂每揿主药含量应为每揿主药含量标示量的80%～120%。6.每喷主药含量：定量喷雾剂每喷主药含量应为标示含量的80%～120%。7.微细粒子剂量：除另有规定外，吸入气雾剂微细药物粒子百分比应不少于每吸主药含量标示量的15%。供雾化器用的吸入喷雾剂应照各品种项下规定的方法测定细微粒子剂量，应符合规定。8.喷射速率：非定量气雾剂每瓶的平均喷射速率（g/s），均应符合各品种项下的规定。9.喷出总量：非定量气雾剂每瓶喷出量均不得少于标示装量的85%。10.每揿喷量：定量气雾剂每瓶10个喷量的平均值。除另有规定外，应为标示喷量的80%～120%。凡进行每揿递送剂量均一性检查的气雾剂，不再进行每揿喷量检查。11.每喷喷量：除另有规定外，定量喷雾剂每瓶10次喷量的平均值均应为标示喷量的80%～120%。凡规定测定每喷主药含量或递送剂量均一性的喷雾剂，不再进行每喷喷量的测定。12.粒度：除另有规定外，中药吸入用混悬型气雾剂若不进行微细粒子剂量测定，应进行粒度检查。将载玻片置距喷嘴垂直方向5cm处喷射一次，将适当处理后，400倍显微镜下检视25个视野，计数，平均原料药物粒径应在5µm以下，粒径大于10µm的粒子不得过10粒。13.装量差异：除另有规定外，单剂量喷雾剂每个的装量与平均装量相比较，超出装量差异限度的不得多于2个，并不得有1个超出限度1倍。凡规定检查递送剂量均一性的单剂量喷雾剂，一般不再进行装量差异的检查。14.装量：非定量气雾剂和非定量喷雾剂照最低装量检查法检查应符合规定。15.无菌：用于烧伤［除程度较轻的烧伤（Ⅰ度或浅Ⅱ度）外］、严重创伤或临床必需无菌的气雾剂和喷雾剂，以及供雾化器用的吸入喷雾剂、定量吸入喷雾剂照无菌检查法应符合规定。16.微生物限度：除另有规定外，气雾剂和喷雾剂照《中国药典》规定的相关检查法检查应符合规定。